下列影响钾跨细胞转移因素的叙述哪项是不正确的？
A. 胰岛素直接刺激Na⁺-K⁺-ATP酶的活性，促细胞摄钾
B. β-肾上腺能的激活通过cAMP机制激活Na⁺-K⁺-ATP酶，促细胞摄钾
C. 酸中毒促进钾离子移出细胞，而碱中毒作用正好相反
D. 细胞外液钾离子浓度升高可直接抑制Na⁺-K⁺-ATP酶的活动
E. 细胞外液渗透压的急性升高促进钾离子自细胞内移出

正确答案：D。细胞外液钾离子浓度升高可直接抑制Na⁺-K⁺-ATP酶的活动

解析：胰岛素可直接直接刺激Na⁺-K⁺-ATP酶的活性，促细胞摄钾（A对）。β-肾上腺能的激活通过cAMP机制激活Na⁺-K⁺-ATP酶，促细胞摄钾（B对）。酸中毒时细胞外液H⁺向细胞内转移，同时移出钾离子以维持电荷平衡，碱中毒时细胞内液H⁺移出细胞外，同时K⁺移入细胞内（C对）。细胞外液钾离子浓度升高可促进Na⁺-K⁺-ATP酶的活动，使钾离子移入细胞（D错，为本题正确答案）。细胞外液渗透压增高，细胞内的水会向细胞外渗透，打破钾离子浓度平衡，即细胞内钾离子浓度升高，细胞外钾离子浓度降低，为重新达到离子浓度平衡，钾离子从细胞内移动向细胞外（E对）。